肘关节外侧疼痛患者，查体Mills征阳性，正确的治疗是
A. 限制肘关节活动
B. 局部注射透明质酸钠
C. 局部注射抗生素
D. 早期手术治疗
E. 限制腕关节活动

正确答案：E。限制腕关节活动

解析：患者主要表现为肘关节外侧疼痛（肱骨外上髁炎常见症状），查体：Mills征阳性（肱骨外上髁炎典型体征），结合患者临床表现初步诊断为：肱骨外上髁炎。据肱骨外上髁炎的标准治疗方案，其中以限制腕关节活动最为关键（E对）。肱骨外上髁炎非手术治疗对绝大多数病人有效，并不优选早期手术治疗（D错）、无需应用抗生素（C错）及限制肘关节活动（A错）。局部封闭一半采用糖皮质激素和利多卡因混合液，而非局部注射透明质酸钠（B错），并且封闭仅用于取得良好的近期效果。